可阻断β受体，用于治疗房性及室性心律失常的药品是
A. 硝酸甘油
B. 利多卡因
C. 氨氯地平
D. 氯沙坦
E. 美托洛尔

正确答案：E。美托洛尔

解析：本题考查美托洛尔。可阻断β受体，用于治疗房性及室性心律失常的药品是美托洛尔（E对）。美托洛尔为β₁受体阻断剂，用于治疗各型高血压（可与利尿药和血管扩张剂合用）及心绞痛。静脉注射对心律失常、特别是室上性心律失常也有效。硝酸甘油（A错）通过降低心肌耗氧量、舒张冠状动脉、增加缺血区血液灌注可用于治疗各种类型心绞痛（包括劳累型心绞痛、变异型心绞痛以及不稳定型心绞痛）。利多卡因（B错）为钠通道阻滞药，主要用于室性心律失常。治疗心脏手术、心导管术、急性心肌梗死及强心苷所致的室性期前收缩、室性心动过速及心室纤颤有效。氨氯地平（C错）为二氢吡啶类钙通道阻滞剂，用于高血压，稳定性心绞痛和变异型心绞痛。氯沙坦（D错）为血管紧张素Ⅱ受体阻断药，用于轻、中度高血压，适用于不同年龄的高血压患者，对伴有糖尿病、肾病和慢性心功能不全患者有良好疗效。